根据《医疗用毒性性药品管理办法》，关于医疗机构使用医疗用毒性药品的说法，错误的是
A. 医疗机构供应和调配毒性药品，凭医师签名的正式处方
B. 每次处方剂量不得超过二日极量
C. 对处方未注明“生用”的毒性药品，应当付炮制品
D. 药师发现处方有疑问，应当拒绝调配，并报告公安部门
E. 处方一次有效，取药后处方保存二年备查

正确答案：D。药师发现处方有疑问，应当拒绝调配，并报告公安部门

解析：本题考查医疗用毒性药品使用管理。根据《医疗用毒性性药品管理办法》，关于医疗机构使用医疗用毒性药品的说法，如发现处方有疑问时，须经原处方医生重新审定后再行调配（D错，为本题正确答案）。医疗机构供应和调配毒性药品，须凭执业医师签名的正式处方（A对）。调配处方时，必须认真负责，计量准确，按医嘱注明要求，并由配方人员及具有药师以上技术职称的复核人员签名盖章后方可发出。对处方未注明“生用”的毒性中药，应当付炮制品（C对）。如发现处方有疑问时，须经原处方医生重新审定后再行调配。处方一次有效，取药后处方保存2年备查（E对）。《医疗用毒性药品管理办法》第九条：医疗单位供应和调配毒性药品，凭医生签名的正式处方。国营药店供应和调配毒性药品，凭盖有医生所在的医疗单位公章的正式处方。每次处方剂量不得超过二日极量。